全胃肠外营养治疗时，补充氮（g）和热量（kcal）的比例一般为
A. 1:10
B. 1:50
C. 1:100
D. 1:150
E. 1:300

正确答案：D。1:150

解析：肠外营养（P102）是指通过胃肠道以外途径（即静脉途径）提供营养支持的方式。一般成人的肠外营养的日供应量（七版黄家驷外科学P380）：氮入量0.15g/kg左右；热卡量25kcal/kg左右，即补充氮（g）和热量（kcal）的比例一般为0.15/25≈1：150（D对）。